1岁小儿，不正确的是
A. 体重9kg
B. 能独走
C. 头围46㎝
D. 能爬台阶
E. 出牙6个

正确答案：D。能爬台阶

解析：正常生长小儿达到1岁时，体重为9Kg；头围达46cm；出牙6颗；逐渐能够独立行走，1.5岁时能够爬台阶。掌握“小儿生长发育规律”知识点。